糖皮质激素治疗慢性特发性血小板减少性紫癜错误的是
A. 一般为首选治疗
B. 一般选用泼尼松
C. 近期有效率约为80%左右
D. 复发时再应用常无效
E. 治疗缓解后一般小剂量维持3～6个月

正确答案：D。复发时再应用常无效

解析：糖皮质激素是慢性特发性血小板减少性紫癜的首选治疗（A对），一般选用泼尼松（B对），近期有效率约为80%左右（C对），但不能根治，停药后易复发，复发时再用有效（D错，为本题正确答案），治疗缓解后一般以小剂量5～10mg/d维持3～6个月（E对）。